甲亢病人，给予他巴唑20mg，1日3次，在家中治疗。半月后需去医院做下列哪项复查
A. 心率、心律
B. 心电图
C. 甲状腺大小
D. 白细胞计数
E. 突眼程度

正确答案：D。白细胞计数

解析：本例患者为甲亢病人，药物治疗常用他巴唑等咪唑类药物。因咪唑类药物可导致粒细胞缺乏症，故该患者半月后需去医院做白细胞计数（D对）的检查，以帮助指导后续治疗。他巴唑通常对心脏无毒害作用，故不需检查心率、心律（A错）、心电图（B错）。甲状腺大小（C错）、突眼程度（E错）有助于了解他巴唑的治疗效果，但患者短期服药后去医院复查此类项目对了解疾病进展意义不大。